女，70岁。间断咳嗽、咳痰10年，活动后气短半年。查体：双肺呼吸音减弱，心率80次/分，律齐。胸部X线未见明显异常。为明确诊断首选的检查是
A. 肺功能
B. 胸部X线
C. 胸部MRI
D. 胸部CT
E. 心电图

正确答案：A。肺功能

解析：患者老年女性（慢阻肺好发人群），间断咳嗽、咳痰10年（常见慢阻肺症状），活动后气短半年（常见心肺功能不全症状）。查体：双肺呼吸音减弱（常见肺功能不全体征），心率80次/分，律齐。胸部X线未见明显异常（慢阻肺早期多无特征的影像学表现）。结合患者病史、临床表现及影像学检查考虑慢性阻塞性肺疾病可能性较大，慢阻肺患者首选肺功能检查（A对）；该患者胸部X线未见明显异常改变，暂无复查胸部X线（B错）必要；胸部MRI（C错）对纵膈疾病和肺血栓栓塞症有较大帮助；胸部CT（D错）主要临床意义在于排除其他具有相似症状的呼吸系统疾病；心电图（E错）常用于心脏循环系统疾病的筛查。